氢氯噻嗪对尿中离子的影响为
A. 排Na⁺增多
B. 排K⁺增多
C. 排Cl⁻增多
D. 排HCO₃⁻增多
E. 排Ca²⁺增多

正确答案：A、B、C、D。排Na⁺增多；排K⁺增多；排Cl⁻增多；排HCO₃⁻增多

解析：本题考查氢氯噻嗪对尿中离子的影响。噻嗪类利尿药增强NaCl和水的排出，产生温和持久的利尿作用。其作用机制是抑制远曲小管近端腔壁上Na⁺-Cl⁻共转运子的功能，由此减少了肾小管上皮细胞对Na⁺和Cl⁻的再吸收，促进肾小管液中Na⁺、Cl⁻和水的排出。由于转运至远曲小管的Na⁺增加，促进了K⁺-Na⁺交换。尿中除排出Na⁺（A对）和Cl⁻（C对）外，K⁺（B对）的排泄也增多，长期服用可引起低血钾。本类药对碳酸酐酶有一定的抑制作用，故略增加HCO₃⁻的排泄（D对）。长期使用易造成高钙血症，所以排Ca²减少（E错）。